下列关于应激的概念描述最为准确的是
A. 外界刺激和环境要求
B. 机体对伤害性刺激的特异性防御反应
C. 对环境适应的反应
D. 机体对伤害性刺激的非特异性防御反应
E. 内外刺激因素

正确答案：D。机体对伤害性刺激的非特异性防御反应

解析：应激的概念最初由加拿大心理学家塞里于1936年首次提出，认为应激是机体对伤害性刺激的非特异性防御反应。拉扎卢斯于1968年提出了心理应激的概念，认为心理应激是人对外界环境有害物、威胁、挑战经认知、评价后所产生的生理、心理和行为反应。掌握“心理应激”知识点。